男，60岁，突发性心前区疼痛2小时既往有高脂血症和吸烟史，无高血压和出血性疾病史，查体：BP150/90mmHg，双肺呼吸音清，心率89次每分钟，律齐，心电图示V1-V6导联ST段弓背向上抬高0.3-0.5mV。该患者最可能的诊断为
A. 变异性心绞痛
B. 下壁心肌梗死
C. 急性前壁心肌梗死
D. 急性广泛前壁心肌梗死
E. 稳定性心绞痛

正确答案：D。急性广泛前壁心肌梗死

解析：患者60岁男性，突发性心前区疼痛2小时，既往有高脂血症和吸烟史，心电图示V1-V6导联ST段弓背向上抬高0.3-0.5mV（急性ST段抬高型心肌梗死特征性改变），故该患者最可能的诊断是急性广泛前壁心肌梗死（D对）。变异型心绞痛（A错）患者也会出现一过性的ST段抬高，但胸痛症状多为数十分钟，持续胸痛2小时者少见。下壁心肌梗死（B错）心电图会出现aVF、Ⅱ和Ⅲ导联ST段抬高。急性前壁心肌梗死（C错）心电图会出现V3-V5导联ST段抬高。稳定型心绞痛（E错）发作时由于心肌缺血心电图ST段压低，而不是抬高。